男，65岁，排便次数增加6个月，伴里急后重，排便不尽感，1个月来，大便变细。偶有大便表面带血，自觉乏力，体重减轻4KG，决定该病人手术方式的要点是
A. 是否合并肠周淋巴结转移
B. 病灶浸润肠壁的深度
C. 病灶下缘据齿状线距离
D. 病灶浸润肠壁的周长
E. 病灶浸润肠壁的长度

正确答案：C。病灶下缘据齿状线距离

解析：老年男性患者，排便次数增加6个月，伴里急后重、排便不尽感（直肠刺激症状），1个月来大便变细（提示癌肿侵犯导致肠管狭窄可能），偶有大便表面带血（提示癌肿破溃出血可能），自觉乏力，体重减轻4Kg，综合患者的症状、体征，初步诊断为直肠癌。决定该病人手术方式的要点是病灶下缘距齿状线距离（C对）。若病灶下缘距齿状线为5cm以上，则选用Dixon术，若病灶下缘距离为5cm以下，则选用Miles术。是否合并肠周淋巴结转移（A错）、病灶浸润肠壁的深度（B错）、病灶浸润肠壁的周长（D错）和病灶浸润肠壁的长度（E错）均不是决定该病人手术方式的要点。